胰头癌最常见的临床表现是
A. 腹痛、黄疸和消瘦
B. 腹痛、黄疸和呕吐
C. 腹痛、黄疸和上腹包块
D. 黄疸、消瘦和上腹包块
E. 黄疸、消瘦和腹胀

正确答案：A。腹痛、黄疸和消瘦

解析：胰头癌最常见的临床表现是腹痛、黄疸和消瘦（A对），而呕吐（B错）、上腹包块（CD错）和腹胀（E错）等症状在胰头癌中较少见或出现较晚。